桂附地黄丸主治
A. 肾阴亏损
B. 肾阳不足
C. 阴虚火旺
D. 精血亏虚
E. 肺肾两虚

正确答案：B。肾阳不足

解析：本题考查的是桂附地黄丸的主治。桂附地黄丸主治肾阳不足（B对）。桂附地黄丸【主治】肾阳不足所致腰痛。症见腰膝酸冷，肢体浮肿，小便不利；畏寒怕冷，四肢欠温，少气乏力，夜尿频多，舌淡，脉沉细。六味地黄丸【主治】肾阴亏损（A错）所致消渴。症见口渴多饮，口干舌燥，尿频量多，浑浊如膏脂，形体消瘦。大补阴丸【主治】阴虚火旺（C错）证。骨蒸潮热，盗汗遗精，咳嗽咯血，舌红少苔，尺脉数而有力。补脑丸【主治】精血亏虚（D错），痰热扰心所致不寐。症见心烦失眠，心悸不宁，头晕耳鸣，五心烦热，舌红，脉细数或滑数。百令胶囊【主治】肺肾两虚（E错）所致肺胀。症见咳声低微，喘促，气短，动则益甚，痰少或痰白而黏，盗汗，神疲乏力，腰膝酸软，舌淡嫩，苔白，脉弱。